属于正经的是
A. 足少阳胆经
B. 十二经别
C. 十二经筋
D. 阴跷脉
E. 十五络脉

正确答案：A。足少阳胆经

解析：十二经脉是经络系统的主体，又称为“正经”。十二经脉的名称是根据手足、阴阳、脏腑来命名的，首先用手、足将十二经脉分为手六经和足六经。根据中医理论，内属阴，外属阳，脏属阴，腑属阳，因此属于五脏和心包、分布于四肢内侧的经脉为阴经，属于六腑、分布于四肢外侧的经脉为阳经。根据阴阳消长的规律，阴阳又分为阴（太阴、厥阴、少阴）阳（阳明、少阳、太阳）十二经脉与脏腑有联属的关系，根据经脉联属的脏腑进一步命名，如联属于肺脏的为肺经，联属于大肠腑的为大肠经。根据上述命名规律，十二经脉的名称即为手太阴肺经、手阳明大肠经、足阳明胃经、足太阴脾、手少阴心经、手太阳小肠经、足太阳膀胱经、足少阴肾经、手厥阴心包经、手少阳三焦经、足少阳胆经（A对）、足厥阴肝经。十二经别是十二正经别行深入体腔的支脉（B错）。十二经筋是十二经脉之气结、聚、散、络于筋肉关节的体系，是附属于十二经脉的筋肉系统（C错）。阴跷脉属于奇经八脉（D错）。十五络脉是十二经脉和任脉、督脉各自别出一络，加上脾之大络，总计15条（E错）。